下列有关Km值的叙述，哪一项是错误的
A. Km值是酶的特征性常数
B. Km值是达到最大反应速度一半时的底物浓度
C. 它与酶对底物的亲和力有关
D. Km值最大的底物，是酶的最适底物
E. 同一酶作用于不同底物，则有不同的Km值

正确答案：D。Km值最大的底物，是酶的最适底物

解析：Km可用来判断酶的最适底物：当酶有几种不同的底物存在时，Km值最小者，为该酶的最适底物。掌握“辅酶与酶促反应”知识点。